执业药师的基本职责是
A. 提供合格药品，维护人民健康
B. 带头执行医药法规
C. 不断更新知识，保持较高专业水平
D. 对药品质量负责
E. 对违反《药品管理法》的行为提出处理意见

正确答案：A。提供合格药品，维护人民健康

解析：本题考查执业药师的基本职责。执业药师的基本职责是提供合格药品，维护人民健康（A对）。执业药师必须遵守执业道德，忠于职守，以对药品质量负责、保证公众用药安全有效为基本原则。带头执行医药法规（B错）、不断更新知识，保持较高专业水平（C错）为执业药师的职业道德准则。执业药师在执业范围内负责对药品质量的监督和管理，参与制定、实施药品全面质量管理及对本单位违反规定的处理（D错）；执业药师负责处方的审核及监督调配，提供用药咨询及与信息开展治疗药物的监测及药品治疗的评价等临床药学工作。执业药师必须严格执行《药品管理法》及国家有关法规的行为或决定，有责任提出劝告、制止、拒绝执行并向上级报告，并不是提出处理意见（E错）。